患者身热，心烦懊恼，坐卧不安，舌苔微黄，脉数其临床意义是
A. 热陷心包证
B. 热灼营阴证
C. 邪热壅肺证
D. 热扰胸膈证
E. 热结肠道证

正确答案：D。热扰胸膈证

解析：气分证多因卫分之邪不解，传入气分，或因温邪直入气分，或气分伏热外发，或邪热由营分转出气分所致。据温邪侵犯肺、胸膈、肠、胆等脏腑的不同，而兼有不同的症状。若热扰胸膈，表现为心烦懊，坐卧不安（D对）。热陷心包证的表现为身灼热，神昏谵语（A错）。热灼伤营阴证表现为身热夜甚，心烦燥扰（B错）。邪热壅肺证表现为咳喘，胸痛，痰黄黏稠（C错）。热结肠道证表现为便秘腹胀，痛而拒按（E错）。